/ml)的主要表现为
A. 腹泻
B. 皮疹
C. 眼球震颤
D. 复视
E. 共济失调

正确答案：C、D、E。眼球震颤；复视；共济失调